下列哪项不是黏液表皮样癌中的肿瘤细胞
A. 黏液细胞
B. 表皮样细胞
C. 肌上皮细胞
D. 中间细胞
E. 杯状细胞

正确答案：C。肌上皮细胞

解析：本题考查黏液表皮样癌中的肿瘤细胞。肌上皮细胞（C错，为本题的正确答案）不是黏液表皮样癌中的肿瘤细胞，含有肌上皮细胞的病变有多形性腺瘤、肌上皮瘤、基底细胞腺瘤等。黏液表皮样癌是由黏液细胞（A对）、表皮样细胞（B对）和中间细胞（D对）构成的恶性唾液腺上皮性肿瘤，其中黏液细胞中的一部分为杯状细胞（E对），胞浆呈泡沫状或网状，胞核较小，位于基部。